毒蛇咬伤后局部症状不显著，疼痛较轻或没有疼痛，仅感局部麻木或蚁行感，伤口出血很少或不出血，周围不红肿，属
A. 混合毒
B. 火毒
C. 神经毒
D. 风火毒
E. 血循毒

正确答案：C。神经毒

解析：毒蛇咬伤后局部症状不显著，疼痛较轻或没有疼痛，仅感局部麻木或蚁行感，伤口出血很少或不出血，周围不红肿，属神经毒（C对）。血液毒（火毒）毒蛇咬伤者在短期内即出现全身中毒症状，恶寒发热、烦躁、口干、全身关节肌肉酸痛、腹痛、腹泻或大便秘结，重者可有广泛的皮下出血或瘀斑，以及内脏出血，如咯血、呕血、便血、尿血等，最终因循环衰竭、休克而死亡（BE错）。混合毒毒蛇咬伤者兼见上述两种表现，混合毒造成死亡的主要原因仍为神经毒，值得注意的是神经毒的吸收速度快，潜伏期较长，局部症状轻，常易被忽视，一旦发作就急骤发展，并难以控制，危险性较大（A错）。风火毒红肿较重，一般多有创口剧痛，或有水疱、血疱、瘀斑或伤处溃烂；全身症状有头晕头痛，眼花，寒战发热，胸闷心悸，大便秘结，小便短赤，严重者烦躁抽搐，甚至神志昏愦；苔白黄相兼，后期苔黄、舌质红，脉弦数（D错）。